以久病咳喘，胸闷心悸，乏力少气，自汗声低为特征的证候是
A. 肺肾气虚
B. 肺气虚
C. 脾肺气虚
D. 心肺气虚
E. 肾气不固

正确答案：D。心肺气虚

解析：“心肺气虚证指心肺两脏气虚，以咳喘、心悸、胸闷与气虚症状为主要表现的证候，临床表现为胸闷，咳嗽，气短而喘，心悸，动则尤甚，吐痰清稀，神疲乏力，声低懒言，自汗，面色淡白，舌淡苔白，或唇舌淡紫，脉弱或结或代，本证以咳喘、心悸、胸闷与气虚症状共见为辨证的主要依据”，本题临床表现与之相符，结合辨证依据，久病肺气虚弱，呼吸功能减弱，失于宣降，则为咳喘；宗气亏虚，气滞胸中，则胸闷；心气虚弱，鼓动无力，则见心悸；气虚脏腑机能衰退，故见乏力少气、声低；肺气虚卫外不固，则自汗，故以久病咳喘，胸闷心悸，乏力少气，自汗声低为特征的证候是心肺气虚证（D对）。“肺肾气虚证，临床表现为咳嗽无力，呼多吸少，气短而喘，动则尤甚，吐痰清稀，声低，乏力，自汗，耳鸣，腰膝酸软，或尿随咳出，舌淡紫，脉弱”（A错）。“肺气虚证，临床表现为咳嗽无力，气短而喘，动则尤甚，咯痰清稀，声低懒言，或有自汗、畏风，易于感冒，神疲体倦，面色淡白，舌淡苔白，脉弱”，本题临床表现与之不相符(B错)。“脾肺气虚证，临床表现为食欲不振，食少，腹胀，便溏，久咳不止，气短而喘，咯痰清稀，面部虚浮，下肢微肿，声低懒言，神疲乏力，面白无华，舌淡，苔白滑，脉弱”，本题临床表现与之不相符（C错）。“肾气不固证，临床表现为腰膝酸软，神疲乏力，耳鸣失聪；小便频数而清，或尿后余沥不尽，或遗尿，或夜尿频多，或小便失禁；男子滑精、早泄；女子月经淋漓不尽，或带下清稀量多，或胎动易滑。舌淡，苔白，脉弱”，本题临床表现与之不相符（E错）。